骨折X线检查的重要意义是
A. 了解骨折的发生机制
B. 明确骨折的诊断
C. 判断骨折的预后
D. 了解组织的损伤情况
E. 了解骨质质密度

正确答案：B。明确骨折的诊断

解析：骨折X线检查对明确骨折的诊断具有重要意义（B对）。此外，还可协助判断骨折的预后（C错）（骨折的愈合情况），但不是其主要目的。骨折的发生机制（A错）可以通过详细询问病史进行了解。组织的损伤情况（D错）主要通过仔细的体格检查和必要的辅助检查（如MRI等）进行了解。拍摄X线平片、骨密度测定，均可了解骨质密度（E错）。